氰化物的毒性主要表现在
A. 对肝脏的损失作用
B. 对肾脏的损伤作用
C. 对大脑的损伤作用
D. 中断呼吸链，造成细胞窒息死亡
E. 对皮肤的刺激作用

正确答案：D。中断呼吸链，造成细胞窒息死亡

解析：本题考查氰化物的毒性主要表现。水源中的氰化物主要来自选矿、有色金属冶炼、金属加工、炼焦、电镀、电子、化工、制革、仪表等工业排放的废水。氰化物经口进入人体后，经胃酸作用形成氰氢酸。游离氰离子与细胞色素氧化酶中的Fe³⁺结合，形成氰化高铁细胞色素氧化酶，使Fe³⁺失去传递电子的能力，中断呼吸链，阻断细胞内氧化代谢过程，造成细胞窒息死亡（D对ABCE错）。